关于糖浆剂质量要求的说法，错误的是
A. 糖浆剂含糖量应不低于45%（g/ml）
B. 根据需要可加不超过0.5%的山梨酸作为抑菌剂
C. 糖浆剂必要时可加入适量的乙醇、甘油或其他多元醇
D. 根据需要可加不超过0.3%的苯甲酸作为抑菌剂
E. 如需加入抑菌剂，除对有规定外，该制剂处方的抑菌效力应符合抑菌效力检査法的规定

正确答案：B。根据需要可加不超过0.5%的山梨酸作为抑菌剂

解析：本题考查的是糖浆剂的质量要求。糖浆剂根据需要可加不超过0.3%的山梨酸作为抑菌剂（B错，为本题正确答案）。糖浆剂：系指含有原料药物的浓蔗糖水溶液。糖浆剂含蔗糖量应不低于45%（g/ml）（A对）。糖浆剂根据需要可加入适宜的附加剂，如需加入抑菌剂，除另有规定外，在制剂确定处方时，该处方的抑菌效力应符合《中国药典》抑菌效力检查法的规定（E对），山梨酸和苯甲酸的用量不得过0.3%（D对），羟苯酯的用量不得过0.05%。必要时，可在糖浆剂中加入适量的乙醇、甘油或其他多元醇（C对）。